将流出的液体滴在吸水纸或纱布上，血迹周围出现一圈被水湿润的环形红晕，表明存在
A. 脑震荡
B. 脑挫裂伤
C. 急性颅内血肿
D. 颅骨骨折
E. 脑脊液漏口腔颌面部邻近颅脑，颌面伤常伴发颅脑损伤

正确答案：E。脑脊液漏口腔颌面部邻近颅脑，颌面伤常伴发颅脑损伤

解析：如鼻孔或外耳道有脑脊液漏出，表明颅前窝底或颅中窝底有骨折。出血伴有脑脊液漏时，将流出的液体滴在吸水纸或纱布上，血迹周围出现一圈被水湿润的环形红晕，表明存在脑脊液漏。掌握“口腔颌面部创伤急救”知识点。